关于药物引起Ⅱ型变态反应的说法，错误的是
A. Ⅱ型变态反应需要活化补体、诱导粒细胞浸润及吞噬作用
B. Ⅱ型变态反应主要导致血液系统疾病和自身免疫性疾病
C. Ⅱ型变态反应只由IgM介导
D. Ⅱ型变态反应可由“氧化性”药物引起，导致免疫性溶血性贫血
E. Ⅱ型变态反应可致靶细胞溶解，又称为溶细胞型反应

正确答案：C。Ⅱ型变态反应只由IgM介导

解析：本题考查Ⅱ型变态反应。Ⅱ型变态反应由IgG或IgM介导（C错，为本题正确答案）；Ⅱ型变态反应又称溶细胞型反应，涉及的抗原比较复杂，药物、病毒或自身抗原都可成为变应原，刺激机体产生IgG或IgM抗体，抗体可特异性地结合到位于细胞表面的抗原上，活化补体、溶解靶细胞（E对）、诱导粒细胞浸润及吞噬作用（A对），引起组织损伤。Ⅱ型变态反应主要涉及血液系统疾病和自身免疫病（B对），可导致免疫性溶血性贫血（D对）。